关于感染过程的描述，错误的是
A. 病原体与人体相互作用，相互斗争的过程称为感染过程
B. 感染过程的构成必须具备病原体、人体和外环境三个因素
C. 病原体侵人人体，临床上出现相应的症状、体征则意味着感染过程的开始
D. 病原体侵人的数量越大的危险也越大
E. 病原体的致病力包括原体数量和变异性

正确答案：C。病原体侵人人体，临床上出现相应的症状、体征则意味着感染过程的开始

解析：病原体通过各种途径进入人体后意味着感染过程的开始（C错，为本题正确答案），而临床上是否出现症状和体征，则取决于病原菌的致病力和机体的免疫功能。感染过程即病原体与人体相互作用，相互斗争的过程（A对）。感染过程由病原体、人体和外环境三个因素构成（B对）。病原体侵入的数量越大，出现显性感染的危险也越大（D对）。病原体的致病力包括毒力、侵袭力、病原体数量和变异性（E对）。